关于注射剂质量要求和临床应用注意事项的说法，错误的是
A. 乳状液型注射液不得有相分离现象
B. 吸潮的注射用无菌粉末可用注射用水配制使用
C. 混悬型注射液不得用于静脉注射
D. 多剂量包装的注射液可加适量的抑菌剂
E. 除另有规定外输液应尽量与血液等渗

正确答案：B。吸潮的注射用无菌粉末可用注射用水配制使用

解析：本题考查的是注射剂的质量要求与临床应用注意事项。注射用无菌粉末吸潮后不可使用（B错，为本题正确答案）。注射用无菌粉末的临床应用注意事项：溶液中不稳定的药物，特别是对湿热十分敏感的药物，如抗生素类药物、酶类制剂或血浆等生物制品常制备成注射用无菌粉末。注射用无菌粉末常使用灭菌注射用水溶解后使用，若粉末吸潮、硬化不易溶解不可使用。注射剂的质量要求：溶液型注射剂应澄清。除另有规定外，混悬型注射液中原料药物粒径应控制在15μm以下，含15～20μm（间有个别20～50μm）者，不应超过10%，若有可见沉淀，振摇时应容易分散均匀。混悬型注射液不得用于静脉注射（C对）或椎管内注射；乳状液型注射液不得有相分离现象（A对），不得用于椎管内注射。静脉用乳状液型注射液中90%的乳滴粒径应在1μm以下，不得有大于5μm的乳滴。除另有规定外，输液应尽可能与血液等渗（E对）。多剂量包装的注射液可加适宜的抑菌剂（D对）。